对肠道杆菌的共同特性叙述错误的是
A. 均为革兰阴性杆菌
B. 均为条件致病菌
C. 鉴别依据生化反应
D. 鉴别依据抗原构造
E. 均含有菌体（O）抗原

正确答案：B。均为条件致病菌